能泻下软坚，善治燥屎坚结难下的药是
A. 昆布
B. 芦荟
C. 瓜蒌
D. 芒硝
E. 胖大海

正确答案：D。芒硝

解析：本题考查的是芒硝的性能特点与功效。能泻下软坚，善治燥屎坚结难下的药是芒硝（D对）。芒硝：【性能特点】本品苦寒沉降，咸能软润，入胃、大肠、三焦经。内服泻热通便，润软燥屎，加速排便，为治实热内结、燥屎坚硬难下之要药；外用能软散坚硬肿块、回乳、清火，为治疮肿、痔疮肿痛所常用。功似大黄，泻热通肠，长于润软、燥结粪便与肿块。既稀软燥结之便，又促肠蠕动而泻热排便，为溶积性泻药，泻热通便力甚强，善治里热燥结之便秘。【功效】泻下，软坚，清热，回乳（外用）。昆布（A错）：【性能特点】本品咸软寒清，入肝、胃、肾经。善消痰软坚，治瘿瘤、瘰疬最宜；兼利水，可治脚气、水肿与小便不利。【功效】消痰软坚，利水消肿。芦荟（B错）：【性能特点】本品苦寒清泄，沉降下行，入大肠与肝经。既泻热通肠，导热毒与湿热外出，又杀肠道寄生虫，促进糟粕与虫体排出，还凉肝而定惊，为治热秘、肝火及小儿热惊、热疳之良药。外用能清火、杀皮肤寄生虫而止痒。泻热通肠与大黄相似，长于凉肝定惊，兼除肠胃湿热而杀虫疗疳，尤以肝经实火、肝郁化火或惊抽兼便秘者用之为佳，小儿疳积兼湿热者尤宜。【功效】泻下，清肝，杀虫。瓜蒌（C错）：【性能特点】本品甘寒清泄滑润，清泄不苦燥，滑肠不峻下，甘润不滞气，入肺、胃、大肠经。既清肺润燥涤痰、利气宽胸开痹，又消肿散结、滑肠通便，善治肺热痰稠咳痰不易、胸痹结胸、乳痈、肺痈、肠痈，以及热结肠燥便秘。【功效】清肺润燥化痰，利气宽胸，消肿散结，润肠通便。胖大海（E错）：【性能特点】本品甘寒质轻，清宣润降。上入肺经而能清宣肺气，治肺失清肃之咳嗽、声哑；下入大肠经而能清热通便，治燥热便秘。然因力缓，故多用于轻症。【功效】清宣肺气，清肠通便。